他汀类药物不用于
A. 2型糖尿病引起的高胆固醇血症
B. 肾病综合征引起的高胆固醇血症
C. 杂合子家族性高脂蛋白血症
D. 高三酰甘油血症
E. 预防心脑血管急性事件

正确答案：D。高三酰甘油血症

解析：本题考查他汀类药物。他汀类药物不用于高三酰甘油血症（D错，为本题正确答案）。他汀类药物临床应用：1.调血脂。适合于杂合子家族性（C对）和非家族性Ⅱa型高脂蛋白血症，Ⅱb型和Ⅲ型高脂蛋白血症也可应用；还可用于2型糖尿病和肾病综合征引起的高胆固醇血症（AB对）。对纯合子家族性高脂血症难以生效，对高甘油三脂血症疗效不显著。2.肾病综合征。3.血管成形术后再狭窄。4.预防心脑血管急性事件（E对）。5.器官移植后的排斥反应和治疗骨质疏松症。